不纳入基本医疗保险用药的有
A. 人参酒
B. 维生素C泡腾片
C. 双黄连口服液
D. 胎盘组织液
E. 复方大青叶

正确答案：A、B、D。人参酒；维生素C泡腾片；胎盘组织液

解析：本题考查的是不得纳入基本医疗保险用药范围的药品。不纳入基本医疗保险用药的有人参酒（A对）、维生素C泡腾片（B对）、胎盘组织液（D对）。不得纳入基本医疗保险用药范围的药品：根据《城镇职工基本医疗保险用药范围管理暂行办法》第四条，不能纳入基本医疗保险用药范围的药品包括：①主要起营养滋补作用的药品；②部分可以入药的动物及动物脏器，干（水）果类；③用中药材和中药饮片泡制的各类酒制剂；④各类药品中的果味制剂、口服泡腾剂；⑤血液制品、蛋白类制品（特殊适应症与急救、抢救除外）；⑥劳动保障部规定基本医疗保险基金不予支付的其他药品。